引起DNA损伤的活性氧主要是
A. H202
B. OH•
C. 102
D. Cl•
E. LOO•

正确答案：B。OH•

解析：OH•（B对）是主要引起DNA损伤的活性氧，自由基可使核酸碱基羟化及 DNA 断裂，这种作用 80%为OH·所致。